心尖搏动位于左锁骨中线外第6肋间考虑为
A. 左心室增大
B. 右心室增大
C. 左心房增大
D. 瘦长体型
E. 心包积液

正确答案：A。左心室增大

解析：正常心尖搏动位置为第5肋间锁骨中线内0.5～1cm，该心尖搏动位于左锁骨中线外第6肋间，发生左下移位，考虑为左心室增大（A对）。右心室增大（B错）时，心尖搏动向左移位。左心房增大（C错）和瘦长体型（D错）者，心尖搏动无明显移位。心包积液（E错）时，心尖搏动减弱，心音低而遥远。